男，68岁。2年前出现过短暂的意识混浊，清醒后有几天听到空中有人在向他打招呼，思维迟缓，情感脆弱，几周后症状明显减轻。近半年来类似症状发作过2次，记忆力明显减退。头颅MRI示大脑多发性腔隙性梗死。最可能的诊断是
A. 精神分裂症
B. 血管性痴呆
C. 癫痫所致精神障碍
D. 阿尔茨海默病
E. 抑郁发作

正确答案：B。血管性痴呆

解析：该老年患者，近半年来以记忆力明显减退为主要表现（痴呆）伴发思维迟缓，情感脆弱，2年前出现过短暂的意识混浊，结合头颅MRI示大脑多发性腔隙性梗死，故最可能诊断为血管性痴呆（B对）。阿尔茨海默病（AD）MRI示内侧颞叶、基底部、外侧颞叶以及内侧顶叶不成比例的萎缩和脑室扩大，伴脑沟裂增宽，与本例不符（D错）。